有形实邪闭阻气机所致的疼痛的性质是
A. 胀痛
B. 灼痛
C. 冷痛
D. 绞痛
E. 隐痛

正确答案：D。绞痛

解析：有形实邪闭阻气机，气机完全阻滞不通，故致痛势剧烈，如刀绞割，即绞痛（D对）。胀痛是由气滞所致（A错）；灼痛是由火（虚火或实火）所致（B错）；冷痛是由寒（实寒或阳虚）所致（C错）；隐痛是因虚导致，为不荣之痛（E错）。